女孩，4岁。夏季突然发病，高热4小时，T39.5℃，惊厥1次，无呕吐、腹泻。病前有可疑不洁饮食史。实验室检查WBC21.0×10⁹/L，N0.86。最可能的诊断是
A. 化脓性脑膜炎
B. 流行性脑脊髓膜炎
C. 流行性乙型脑炎
D. 热性惊厥
E. 中毒性细菌性痢疾

正确答案：E。中毒性细菌性痢疾

解析：4岁患儿（属于2～7岁），有不洁饮食史，夏秋季节突起高热伴惊厥，应诊断为中毒性细菌性痢疾（E对）。化脓性脑膜炎（A错）、流行性脑脊髓膜炎（B错）、流行性乙型脑炎（C错）都属于脑膜炎的范畴，脑膜炎的典型特征是脑膜刺激征与颅内压增高（表现为头痛呕吐），而该患儿并无呕吐，因此可排除这三个选项。虽然热性惊厥也有突然发热和惊厥的表现，但不会有不洁饮食史（D错）。